药用液体石蜡灭菌宜采用的方法是
A. 火焰灭菌法
B. 干热空气灭菌法
C. 热压灭菌法
D. 流通蒸汽灭菌法
E. 低温间歇灭菌法

正确答案：B。干热空气灭菌法